下列各项，除哪项外，均属小儿正常语言发育
A. 2-3个月会笑
B. 4个月会笑出声音
C. 10个月能发复音
D. 1岁半能用几个字连成单语
E. 7岁以上能较好地掌握语言

正确答案：D。1岁半能用几个字连成单语

解析：小儿1岁时能说出简单的生活用语，如吃、走、拿等，1岁半时已能用语言表达自己的要求（D对）。2个月能发出和谐喉音，3个月发出咿呀之声，五版教材言2-3个月会笑（A错）。4个月已能发出笑声（B错）。7~8个月会发复音，如“妈妈”、“爸爸”等，故10个月能发复音正常（C错）。五版教材言7岁以上能较好地掌握语言（E错）。